门静脉高压症手术治疗最主要的目的是
A. 消除脾功能亢进
B. 治疗食管胃底静脉破裂出血
C. 降低门静脉压力以减少腹水
D. 增加门静脉向肝灌注血流以减少肝性脑病的发生
E. 治疗门静脉血液瘀滞所致的胃粘膜病变

正确答案：B。治疗食管胃底静脉破裂出血

解析：门静脉高压症可导致食管胃底静脉曲张破裂大出血，这是门脉高压症最常见的并发症，难以止血，死亡率高。其手术治疗最主要的目的就是治疗食管胃底静脉破裂出血（B对）。对严重脾大、合并脾功能亢进的患者可行脾切除，但这并非门静脉高压症手术治疗的主要方面和目的（A错）。分流术可以降低门静脉压力，减少腹水生成，但鉴于肝功能受损，减少腹水效果并不明显，降低门静脉压力以减少腹水（C错）并不是其治疗目的。贲周血管离断术可增加门静脉压和肝血流量，而不是增加门静脉向肝灌注血流（D错）。门静脉高压性胃病所导致的上消化道出血仅占5%～20%，且出血量小。因此，治疗门静脉血液瘀滞所致的胃粘膜病变（E错）不是手术治疗的主要目的。